不参与桡腕关节组成的是
A. 尺骨下端
B. 桡骨下端
C. 月骨
D. 三角骨
E. 无

正确答案：A。尺骨下端

解析：桡腕关节由手的舟骨、月骨（C对）和三角骨（D对）的近侧关节面作为关节头，桡骨下端（B对）的腕关节面和尺骨头下端（A错，为本题正确答案）的关节盘作为关节窝而构成。